恶性或急进型高血压患者血压（舒张压）持续
A. ≥130mmHg
B. ≤130mmHg
C. ＜130mmHg
D. ＞130mmHg
E. ≥150mmHg

正确答案：A。≥130mmHg

解析：本题考查原发性高血压。少数恶性或急进型高血压患者病情急骤发展，舒张压持续≥130mmHg（A对）。